子宫小于孕3个月的稽留流产，其处理原则应是
A. 先给予抗生素行钳刮术
B. 立即行宫颈扩张及钳刮术
C. 先给予催产素，后行钳刮术
D. 先给予雌激素，后行钳刮术
E. 药物引产

正确答案：D。先给予雌激素，后行钳刮术

解析：稽留流产的处理较困难，若凝血功能正常，先口服炔雌醇，可提高子宫肌对缩宫素的敏感性，然后再刮宫。掌握“自然流产”知识点。